ANUG发生的重要条件是
A. 慢性龈炎或牙周炎
B. 慢性龈炎或牙髓炎
C. 慢性牙髓炎或牙周炎
D. 慢性唇炎或牙髓炎
E. 慢性唇炎或牙周炎

正确答案：A。慢性龈炎或牙周炎

解析：牙齿已存在的慢性龈炎或牙周炎是ANUG发生的重要条件。掌握“坏死性溃疡性龈炎”知识点。